能导致维生素B₁₂吸收不良的药物是
A. 秋水仙碱
B. 苯溴马隆
C. 非布司他
D. 碳酸氢钠
E. 别嘌醇

正确答案：A。秋水仙碱

解析：本题考查药物相互作用。秋水仙碱（A对）会导致可逆性的维生素B₁₂吸收不良。